既能祛风湿，又能补肝肾，还能安胎的药物是
A. 牛膝
B. 杜仲
C. 桑寄生
D. 续断
E. 五加皮

正确答案：C。桑寄生

解析：桑寄生具有祛风湿，补肝肾，强筋骨，安胎的功效属于既能祛风湿，又能补肝肾，还能安胎的药物（C对）。牛膝的功效是活血通经，补肝肾，强筋骨利水通淋，引火（血）下行（A错）。杜仲的功效是补肝肾，强筋骨，安胎（B错）。续断的功效是补益肝肾，强筋筋骨，止血安胎，疗伤续折（D错）。五加皮的功效是祛风湿，补肝肾，强筋骨，利水 （E错）。